女，30岁。进行性痛经8年，婚后5年未孕。妇科检查：子宫大小正常，后位，固定，盆底可触及多个结节，右侧附件区触及直径约6厘米的囊性包块，不活动，左侧附件区组织略增厚。首先考虑的诊断是
A. 盆腔结核
B. 原发性痛经
C. 慢性盆腔炎
D. 子宫内膜异位症
E. 卵巢肿瘤

正确答案：D。子宫内膜异位症

解析：该患者为育龄期女性，进行性痛经8年，婚后5年未孕（子宫内膜异位症好发于育龄期妇女，典型症状为继发性痛经、进行性加重，不孕率达40%）。妇检：子宫大小正常，盆底可触及多个结节，右侧附件区触及直径约6厘米的囊性包块，不活动，左侧附件区组织略增厚（典型盆腔内异症双合诊检查时，可发现子宫后倾固定，直肠子宫陷凹、宫骶韧带或子宫后壁下方可扪及触痛性结节，一侧或双侧附件处触及囊实性包块，活动度差），首先考虑的诊断是子宫内膜异位症（D对）。盆腔结核（P265）（A错）表现为不孕、月经失调，下腹坠痛、发热盗汗等全身症状。原发性痛经（P362）（B错）在青春期多见，疼痛多自月经来潮后开始，最早出现在经前12小时，以行经第一日疼痛最剧烈，伴有恶心呕吐等症状。慢性盆腔炎（P261）（C错）表现为发热、阴道分泌物增多、下腹痛等炎症表现，进行性痛经表现不明显。卵巢肿瘤（P323）（E错）主要症状为腹胀、腹部肿块、腹腔积液等。